对诊断心肌梗死最有意义的是
A. 淀粉酶
B. 血清转氨酶
C. 谷氨酰基转肽酶
D. 血清碱性磷酸酶
E. 肌酸磷酸激酶

正确答案：E。肌酸磷酸激酶

解析：对诊断心肌梗死最有意义的是肌酸磷酸激酶（CK）（E对），在AMI发病3～8小时时CK水平即明显增高。淀粉酶（A错）对胰腺炎具有诊断意义。血清转氨酶（B错）对急、慢性病毒性肝炎、肝硬化等有诊断意义。谷氨酰基转肽酶（C错）对原发性或转移性肝癌、阻塞性黄疸、急、慢性病毒性肝炎有诊断意义。血清碱性磷酸酶（D错）对佝偻病、骨质疏松、骨细胞癌有诊断意义。